某校在1998年8月底突然发生大批腹泻病人，不少人需住院治疗，临床诊断为细菌性痢疾。立即进行流行病学调查，查了3894人，共查出病例703人。最好用下更哪种指标
A. 发病患为18.1%
B. 现患率为18.1%
C. 罹患率为18.1%
D. 续发率为18.1%

正确答案：C。罹患率为18.1%

解析：本题考查罹患率的概念。罹患率（C对ABD错）是测量某人群某病新病例发生频率的指标，通常指在某一局限范围短时间内的发病率。罹患率指标在食物中毒、职业中毒或传染病的暴发及流行中经常使用。本题中的症状属于食物中毒，满足罹患率的应用条件，根据信息可知罹患率为18.1%。